患者青年男性，右上腹疼痛不适，无畏寒、发热、黄疸。血AFP阳性，B超：肝右叶1.5cm占位病变，最适宜的治疗方法
A. 手术切除
B. 化疗
C. 放疗
D. 免疫治疗
E. 肝移植

正确答案：A。手术切除

解析：青年男性患者，右上腹疼痛不适，血AFP阳性，B超：肝右叶1.5cm占位病变，考虑最可能的诊断为原发性肝癌，早期，且属于微小肝癌，最适宜的治疗方法是手术切除（A对），部分肝切除是治疗肝癌首选和最有效的方法。放、化疗（B、C错）及免疫治疗（D错）主要用于肝癌晚期、转移或者术后复发者。肝移植（E错）用于切除肿瘤和硬化的肝。